左旋多巴是由以下哪种物质形成儿茶酚胺的中间产物（DA前体）
A. 酪氨酸
B. 苏氨酸
C. 缬氨酸
D. 色氨酸
E. 天冬氨酸

正确答案：A。酪氨酸

解析：左旋多巴是由酪氨酸形成儿茶酚胺的中间产物，即DA的前体。掌握“左旋多巴、卡比多巴、苯海索”知识点。